男，40岁。饮酒后持续性上腹疼痛10小时，向腰背部放射，伴恶心，呕吐，发热，无血尿。对明确诊断最有意义的检查是
A. 血淀粉酶
B. 血常规
C. 血清脂肪酶
D. 尿淀粉酶
E. 腹部X线平片

正确答案：A。血淀粉酶

解析：患者表现为饮酒后持续性上腹疼痛，向腰背部放射，伴恶心，呕吐，发热，考虑诊断为急性胰腺炎。患者起病10小时，血淀粉酶（A对）于起病后2-12小时开始升高，对明确诊断最有意义，血清脂肪酶（C错）于起病后24-72小时才开始升高。血常规（B错）异常，白细胞升高，但没有特异性。尿淀粉酶（D错）对急性胰腺炎的诊断没有意义。腹部X线平片（E错）由于受到胃肠积气的干扰，对胰腺炎诊断意义不大。